男，60岁，间断心前区压榨感及咽部不适，尝试步行200米后，需停下休息5分钟，平板实验阳性。诊断为
A. 变异型心绞痛
B. 稳定型心绞痛
C. 初发型心绞痛
D. 不稳定性心绞痛
E. 心肌梗死

正确答案：B。稳定型心绞痛

解析：稳定型心绞痛多在劳动或情绪激动时发生（步行200米后发生），持续数分钟，休息或用硝酸酯制剂（休息5分钟），胸痛迅速缓解。本例符合稳定型心绞痛（B对）的特点。变异型心绞痛（A错）常发生于安静时，程度较重，持续时间较长，可达数小时或更长，休息和含用硝酸甘油片多不能缓解，心肌酶正常。初发型心绞痛（C错）指首发1-2月内以内的心绞痛，本例并未提及时间。不稳定型心绞痛（D错）通常程度更重，持续时间更长，可达数十分钟，胸痛在休息时也可发生，与本例不符。心肌梗死（E错）常发生于安静时，持续时间可达数小时或更长，休息和含用硝酸甘油片多不能缓解，心肌酶升高。